白僵蚕具有的功效是
A. 收敛生肌
B. 明目去翳
C. 化痰散结
D. 燥湿化痰
E. 消痰行水

正确答案：C。化痰散结

解析：该题考查白僵蚕的功效，属记忆内容。白僵蚕味咸、辛，性平；入肝、肺经；具有息风止痉，祛风止痛，化痰散结的功效（C对ABDE错）。